最易形成慢性感染的病原体是
A. 人类免疫缺陷病毒（HIV）
B. 乙型肝炎病毒（HBV）
C. 甲型肝炎病毒（HAV）
D. 单纯疱疹病毒（HSV）
E. 人类乳头瘤病毒（HPV）

正确答案：B。乙型肝炎病毒（HBV）